关于普萘洛尔抗心绞痛方面，哪项错误
A. 对变异性心绞痛效果好
B. 与硝酸甘油合用效果好
C. 对兼有高血压的效果好
D. 久用后不宜突然停药
E. 对稳定型和不稳定型的都有效

正确答案：A。对变异性心绞痛效果好